虚的病机最根本的方面是
A. 气血生化不足
B. 正气虚损
C. 卫气不固
D. 气化无力
E. 脏腑功能低下

正确答案：B。正气虚损

解析：虚，指正气不足，是以正气虚损为矛盾主要方面的病机变化（B对）。虚证，多见于素体虚弱，精气不充；或外感病的后期，以及各种慢性病证日久，耗伤人体的精气血津液，或正气化生无源；或因暴病吐泻、大汗、亡血等使正气随津血而脱失，以致正气虚弱，气血生化不足、卫气不固、气化无力、脏腑功能低下均是虚证的具体表现（ACDE错）。